关于社区卫生服务的主要内容，不正确的说法是
A. 社区健康教育
B. 社区预防与康复
C. 慢性病防治与管理
D. 疑难重症的诊疗
E. 计划生育技术指导

正确答案：D。疑难重症的诊疗